玄参的功效有
A. 定惊
B. 清热凉血
C. 凉血活血
D. 滋阴降火
E. 解毒散结

正确答案：B、D、E。清热凉血；滋阴降火；解毒散结

解析：本题考查的是玄参的功效。玄参的功效有清热凉血（B对）、滋阴降火（D对）、解毒散结（E对）。玄参：【功效】清热凉血，滋阴降火，解毒散结，润肠。水牛角：【功效】清热凉血，泻火解毒，定惊（A错）。紫草：【功效】凉血活血（C错），解毒透疹。